女性，58岁，绝经10年，阴道流血伴流液2个月就诊。行分段诊刮，诊断为子宫内膜癌Ⅰ期。首选治疗方案为
A. 盆腔内放射治疗
B. 盆腔外照射治疗
C. 子宫全切术
D. 扩大子宫全切术+双附件切除术
E. 子宫广泛切除术+盆腔淋巴结清扫术

正确答案：D。扩大子宫全切术+双附件切除术

解析：中年女性患者，子宫内膜癌I期，局限于子宫体，且年纪较大，无生育需求，首选的治疗方案为扩大子宫全切术+双附件切除术（D对），手术是子宫内膜癌的首选治疗方法，放射治疗主要用于晚期无法手术治疗的患者（AB错），年轻无高危因素的患者，可考虑保留卵巢，行单纯子宫全切术（C错），病变侵犯宫颈间质者行改良广泛性子宫切除、双侧附件切除及盆腔和腹主动脉旁淋巴结切除（E错）。